垂体分泌
A. GnRH
B. 促性腺激素
C. 性激素，包括雌激素、孕激素和少量雄激素
D. 绒毛膜促性腺激素
E. 糖皮质激素、盐皮质激素

正确答案：B。促性腺激素

解析：本题考查垂体分泌的激素。垂体分泌的激素较多，其中促性腺激素（B对ACDE错）是促进男女性的性腺发育，如女性的卵泡发育，男性的精子发育都和促性腺激素相关，如果垂体出现了问题造成激素分泌不足，可能会引起各种疾病，如甲减、闭经、不孕不育等。